男，30岁。工作时跌入80℃热水池内，臀部、双下肢及足部淹没热水中3分钟，均为Ⅱ度烧伤（烫伤），其受伤面积估计为
A. 30%～35%
B. 36%～40%
C. 41%～45%
D. 46%～50%
E. 51%～60%

正确答案：D。46%～50%